女性20岁，诉咀嚼无力，口检左右上6颊侧牙周袋6mm，松动Ⅱ°，口腔卫生一般，牙石I°，拟诊
A. 青春期牙周炎
B. 慢性龈炎
C. 单纯性牙周炎
D. 复合性牙周炎
E. 以上均不对

正确答案：A。青春期牙周炎

解析：本题考查局限型侵袭性牙周炎的临床表现。女性20岁，诉咀嚼无力，口检左右上6颊侧牙周袋6mm，牙石Ⅰ°，符合青春期牙周炎（A对）的临床特点。慢性龈炎（B错）无附着丧失，也无牙槽骨吸收，形成的是假性牙周袋。单纯性牙周炎（C错）是指主要由局部因素引起的牙周支持组织的慢性炎症，发病年龄以35岁以后较为多见，故又名成人牙周炎，它是由慢性龈炎发展而来，但病损的范围和程度更甚。复合性牙周炎（D错）指单纯性牙周炎伴有较明显的牙合创伤，牙合创伤可以是原发的，也可以是继发的，主要临床表现与单纯性牙周炎相同，如形成牙周袋、牙槽骨吸收、牙龈炎性肿胀及出血、牙齿逐渐松动等，但由于本病合并有较明显的牙合创伤，使牙周炎症较为严重。